选择100例肝癌患者和200例对照进行饮酒与肝癌关系的病例对照研究，调查发现100例患者中有50人饮酒，200例对照中也有50人饮酒，肝癌与饮酒的相对危险度是
A. 1
B. 1.5
C. 2
D. 2.5
E. 3

正确答案：E。3

解析：本题考查相对危险度。本题为病例对照研究，因此不能直接计算RR，可用OR来近似估计RR，计算出OR＝（50×150）/（50×50）＝3（E对ABCD错）。